一侧肺尖部局限性响性水泡音的是
A. 肺炎球菌性肺炎
B. 急性肺水肿
C. 支气管扩张症
D. 肺结核
E. 肺淤血

正确答案：D。肺结核

解析：湿啰音又叫水泡音，一侧肺尖部局限性响性水泡音的是肺结核（D对）。两肺散在性湿啰音，常见于支气管炎、支气管肺炎、血行播散型肺结核、肺水肿；两肺底湿啰音，多见于肺淤血（E错）、肺水肿（D错）及支气管肺炎。粗湿啰音∶又称大水泡音。产生于气管、大支气管或空洞内，多出现在吸气早期。见于肺结核空洞、肺水肿、昏迷或濒死的患者，也可见于支气管扩张症（C错）。肺炎球菌性肺炎又叫大叶性肺炎，充血期可听及捻发音，实变期可听及病理性支气管呼吸音，消散期逐渐被湿性啰音（A错）。